西红花的功效有
A. 活血祛瘀
B. 利尿通淋
C. 引血下行
D. 凉血解毒
E. 解郁安神

正确答案：A、D、E。活血祛瘀；凉血解毒；解郁安神

解析：本题考查的是西红花的功效。西红花的功效是活血祛瘀（A对），凉血解毒（D对），解郁安神（E对）。西红花：【功效】活血祛瘀，凉血解毒，解郁安神。牛膝：【功效】活血通经，利尿通淋（B错），引血下行（C错），补肝肾，强筋骨。